给恋物癖者电击的方法属于
A. 家庭脱敏
B. 冲击疗法
C. 厌恶疗法
D. 松弛疗法
E. 自由联想

正确答案：C。厌恶疗法

解析：厌恶治疗基本上是“处罚”消除法，即依据“负性条件”消除目标行为。负性条件除了电击、针刺，还包括治疗者的皱眉、摇头不赞成，口头的训诫，在皮肤上的刺痛，限制舒服行为的发生 （如不准看电影、不准外出等等）（C对）。厌恶疗法主要适用于露阴癖、恋物癖、酒精依赖及强迫症等。